肺炎链球菌主要导致的疾病是
A. 支气管炎
B. 化脓性脑膜炎
C. 大叶性肺炎
D. 小叶性肺炎
E. 支气管哮喘

正确答案：C。大叶性肺炎

解析：肺炎链球菌所致疾病：主要为大叶性肺炎，其次为支气管炎和化脓性脑膜炎等。掌握“链球菌属”知识点。